某药品生产企业生产的药品“活络止痛丸”，其功能主治为“活血舒筋，驱风除湿。用于风湿痹痛。手足麻木酸软”。在获得药品广告审查部门批准之后，广告在发布过程中出现“服用3天颈椎就不疼了；3周后10年的老风湿完全好了；服药90天变硬变形的关节恢复正常，骨病康复，行动自如”等广告内容。对上述信息中的违法药品广告行为，药品广告市查部门应采取的措施，不包括
A. 撤销广告批准文号
B. 责令该企业停产整顿
C. 暂停该药品在辖区内的销售
D. 责令该企业在当地相应媒体上发布更正启事

正确答案：B。责令该企业停产整顿

解析：本题考查违反药品广告管理的处罚。某药品生产企业生产的药品“活络止痛丸”，其功能主治为“活血舒筋，驱风除湿。用于风湿痹痛。手足麻木酸软”。在获得药品广告审查部门批准之后，广告在发布过程中出现“服用3天颈椎就不疼了；3周后10年的老风湿完全好了；服药90天变硬变形的关节恢复正常，骨病康复，行动自如”等广告内容。对上述信息中的违法药品广告行为，药品广告市查部门应采取的措施，不包括责令该企业停产整顿（B错，为本题正确答案）或暂停该药品在辖区内的销售（C错，为本题正确答案）。违反药品广告管理进行虚假宣传的处罚：进行虚假宣传的，依照《广告法》第五十八条的规定处罚，由市场监督管理部门责令停止发布广告，责令广告主在相应范围内消除影响，处广告费用一倍以上三倍以下的罚款，广告费用无法计算或者明显偏低的，处十万元以上二十万元以下的罚款；情节严重的，处广告费用三倍以上五倍以下的罚款，广告费用无法计算或者明显偏低的，处二十万元以上一百万元以下的罚款，可以吊销营业执照，并由广告审查机关撤销广告审查批准文件、一年内不受理其广告审查申请。构成虚假广告的，依照《广告法》第五十五条的规定处罚，由市场监督管理部门责令停止发布广告，责令广告主在相应范围内消除影响（D对），处广告费用三倍以上五倍以下的罚款，广告费用无法计算或者明显偏低的，处二十万元以上一百万元以下的罚款；两年内有三次以上违法行为或者有其他严重情节的，处广告费用五倍以上十倍以下的罚款，广告费用无法计算或者明显偏低的，处一百万元以上二百万元以下的罚款，可以吊销营业执照，并由广告审查机关撤销广告审查批准文件（A对）、一年内不受理其广告审查申请。对于其他发布虚假药品广告的情形，《广告法》及其他法律法规有规定的，依照相关规定处罚，没有规定的，由县级以上市场监督管理部门责令改正；对负有责任的广告主、广告经营者、广告发布者处以违法所得三倍以下罚款，但最高不超过三万元；没有违法所得的，可处一万元以下罚款。